调查发现某高原地区居民结肠癌发病率高于全国平均水平，研究者注意到该地区人民饮食习惯均有高脂肪摄入，低水果，蔬菜摄入的特点，拟开展一项课题研究，分析饮食习惯与结肠癌的关系，考虑到因果现象发生的时间顺序，最佳的研究方式为
A. 生态学研究
B. 队列研究
C. 横断面研究
D. 临床对照研究
E. 临床试验

正确答案：B。队列研究

解析：调查发现某高原地区居民结肠癌发病率高于全国平均水平，研究者注意到该地区人民饮食习惯均有高脂肪摄入，低水果，蔬菜摄入的特点，拟开展一项课题研究，分析饮食习惯与结肠癌的关系，这是一项“由因寻果”的课题研究，故最佳的研究方式为队列研究（B对）。生态学研究是在群体的水平上研究某种因素与疾病之间的关系（A错）。横断面研究是在某一特定时间对某一范围内的人群，以单人为单位收集和描述人群的特征以及疾病或健康状况（C错）。临床对照研究是在保证其他因素一致，以单一变量为主进行对照试验（D错）。临床试验是指任何在人体（病人或健康志愿者）进行药物的系统性研究（E错）。